下列哪项检查容易引起泌尿系感染
A. 肾盂造影
B. 导尿
C. 核素肾图检查
D. 肾穿刺
E. 血液透析

正确答案：B。导尿

解析：泌尿道感染，是由各种病原微生物入侵泌尿道引起的尿路感染性疾病，细菌是尿路感染中最多见的病原微生物，导尿操作中容易并发细菌感染（B对）。除此之外泌尿系感染的易感因素包括尿路梗阻、尿路畸形、性别因素、机体抵抗力下降、遗传因素（ACDE错）。